哪种药物对心房颤动无效
A. 奎尼丁
B. 地高辛
C. 普萘洛尔
D. 胺碘酮
E. 利多卡因

正确答案：E。利多卡因